下列各项，不属于青皮主治病症的是
A. 胸胁胀痛
B. 乳房胀痛
C. 食积腹痛
D. 疝气疼痛
E. 呕吐呃逆

正确答案：E。呕吐呃逆

解析：青皮苦泄辛行温通，性猛入肝，善于疏理肝胆之气，尤宜于肝郁气滞诸症，可治疗肝郁气滞，胸胁胀痛（A对）、乳房胀痛（B对）、寒疝疼痛等；辛行苦降，既能消积，又能行气止痛，常用于治疗食积腹痛（C对）。青皮性烈，偏入肝胆，偏行肝胆之气，善于疏肝破气，又能消积化滞，但不能降逆止呕，不用于呕吐呃逆（E错，为本题正确答案）。